慢性牙髓炎的疼痛特点
A. 剧烈的自发性疼
B. 剧烈的夜间疼
C. 牵涉性疼
D. 轻微的自发性钝痛
E. A+B+C

正确答案：D。轻微的自发性钝痛

解析：本题考查慢性牙髓炎的疼痛特点。慢性牙髓炎的疼痛特点是轻微的自发性钝痛（D对）。慢性牙髓炎是临床上最为常见的一型牙髓炎，常由急性牙髓炎发展而来，有自发痛史，慢性期一般不发生剧烈的自发性疼（A错）、无剧烈的夜间痛（B错）、无牵涉性痛（C错）等急性牙髓炎症状。但有时出现轻微的自发性钝痛，疼痛症状不明显。